上（牙合）架时面弓的作用是
A. 实现平衡（牙合）
B. 确定前伸髁导斜度
C. 确定侧方髁导斜度
D. 转移患者上颌对颞下颌关节的位置关系，正确固定上颌模型的位置
E. 保持（牙合）关系稳定

正确答案：D。转移患者上颌对颞下颌关节的位置关系，正确固定上颌模型的位置

解析：本题考查颌位关系转移-面弓的作用。面弓转移上（牙合）架来转移患者上颌对颞下颌关节的位置关系，正确固定上颌模型的位置（D对），以提高该位置在模型和（牙合）架上的准确性，减少最终义齿咬合关系的偏差。要实现平衡（牙合）（A错）是通过合理的排牙，也可以保持（牙合）关系稳定（E错）。确定前伸髁导斜度（B错）是利用上下（牙合）托取得前伸（牙合）位记录。确定侧方髁导斜度（C错）是利用侧方（牙合）蜡（牙合）记录的方法或者Hanau公式（侧方髁导斜度=前伸髁导斜度/8+12）。